与Molish试剂反应产生棕色环的是
A. 大黄素
B. 大黄素-β-葡萄糖苷
C. 二者均有此性质
D. 二者均无此性质

正确答案：B。大黄素-β-葡萄糖苷

解析：本题考查的是苷类的显色反应。与Molish试剂反应产生棕色环的是大黄素-β-葡萄糖苷（B对）。大黄素-β-葡萄糖苷分子中含糖，可发生Molish反应。苷类化合物由苷元和糖两部分组成，故苷类化合物能发生相应的苷元和糖的各种显色反应。苷元的结构多种多样。糖的显色反应中最重要的是Molish反应，常用的试剂由浓硫酸和α-萘酚组成。硫酸兼有水解苷键的作用，生成的单糖在浓硫酸的作用下，失去三分子水，生成具有呋喃环结构的醛类化合物。由五碳糖生成的是糠醛，甲基五碳糖生成的是5-甲糠醛，六碳糖生成的是5-羟甲糠醛。这些糠醛衍生物和许多芳胺、酚类可缩合成有色物质，可借此来检识糖和苷类化合物的存在。大黄素（A错）类蒽醌其羟基分布于两侧的苯环上，多数化合物呈黄色。羟基蒽醌类衍生物多与葡萄糖、鼠李糖结合成苷存在。